下列描述错误的是
A. 表面光滑
B. 参与构成关节
C. 表层有关节软骨覆盖
D. 表面有骨膜
E. 无

正确答案：D。表面有骨膜

解析：骨的关节面是参与组成关节（B对）的各相关骨的接触面。关节面表面覆盖有关节软骨（C对），使关节面表面光滑（A对）。骨膜是由纤维结缔组织构成的，覆盖于关节面以外的骨表面（D错，为本题正确答案）。